脱水或极度消瘦患儿可表现为
A. 前囟饱满
B. 前囟隆起
C. 前囟凹陷
D. 前囟闭合过早
E. 前囟闭合过迟

正确答案：C。前囟凹陷

解析：前囟饱满、紧张、隆起，常表示颅内压增高，是婴儿脑膜炎、脑炎或脑积水等重要体征之一；前囟凹陷常见于脱水或极度消瘦患儿。掌握“骨骼发育”知识点。